下列各项，不是胃癌X线表现的是
A. 充盈缺损
B. 胃腔狭窄，胃壁僵硬
C. 位于胃轮廓之外的龛影
D. 粘膜皱襞破坏，消失或中断
E. 肿瘤区蠕动消失

正确答案：C。位于胃轮廓之外的龛影

解析：胃部X线表现，若看到位于胃轮廓之外的龛影（C错，为本题正确答案）则为胃溃疡的征象，胃癌可以看到位于胃轮廓之内的龛影。早期胃癌可以看到显示小的充盈缺损（A对），表面多不光整，基部稍宽，附近粘膜增粗、紊乱，可与良性息肉鉴别。中晚期胃癌可以表现为粘膜纹异常增粗或消失（D对），局限性胃壁僵硬，胃腔固定狭窄，在同一位置不同时期摄片，胃壁可出现双重阴影，说明正常蠕动的胃壁和僵硬胃壁轮廓相重。广泛浸润型的粘膜皱襞平坦或消失，胃腔明显缩小，整个胃壁僵硬（B对），无蠕动波可见（E对）。